结构中具有咖啡酰基
A. 没食子酸
B. 绿原酸
C. 二者均有
D. 二者均无

正确答案：B。绿原酸

解析：本题考查的是有机酸。结构中具有咖啡酰基的是绿原酸（B对）。绿原酸的结构及其特点：绿原酸为一分子咖啡酸与一分子奎宁酸结合而成的酯，即3-咖啡酰奎宁酸；异绿原酸是绿原酸的同分异构体，为5-咖啡酰奎宁酸。3,4-、3,5-、4,5-二咖啡酰奎宁酸均为两分子咖啡酸与一分子奎宁酸结合而成的酯类化合物。没食子酸（A错）为没食子酸鞣质的水解产物。没食子酸鞣质水解后可产生没食子酸（或其缩合物）和多元醇。